治疗心房颤动
A. 地高辛
B. 奎尼丁
C. 两者均可
D. 两者均不可

正确答案：B。奎尼丁